男4岁，因怀疑先天性心脏病就诊。2个月后患儿出现发热伴咽痛，2周后出现头痛。右侧巴氏征（+），WBC18×10⁹/L，中性0.86，淋巴0.14.考虑合并
A. 肺炎
B. 脑出血
C. 脑脓肿
D. 心肌炎
E. 结核性脑膜炎

正确答案：C。脑脓肿

解析：先天性心脏病常易并发脑脓肿，该患儿有发热、头痛、右侧巴氏征（+）、白细胞增高以中性粒细胞为主进一步验证合并有脑脓肿（C对）。肺炎有与患儿相似的发热、咽痛的症状，一般同时还会伴有咳嗽、肺部湿罗音的体征，该病例不符合肺炎的特征（A错）。脑出血有颅内压增高的临床症状，但不会有发热和咽痛的变现，因此脑出血与题意不符（B错）。小儿心肌炎一般是风湿热的并发症，而不是先天性心脏病的并发症（D错）。结核性脑膜炎以淋巴细胞为主（而该患儿是以中性粒细胞升高为主）（E错）。